“证候”不包括
A. 四诊检查所得
B. 内外致病因素
C. 疾病的特征
D. 疾病的性质
E. 疾病的全过程

正确答案：E。疾病的全过程

解析：证候包括四诊检查所得的症（A对），证候是病机的外在反映，病机是证候的内在本质，而病机又包括内外致病因素（B对）、疾病的特征（C对）和性质（D对）等。证候是某一阶段的病理概括，而病反映了某一疾病全过程的总体属性、特征等（E错，为本题正确答案）